女，28岁。婚后5年未孕，月经稀发肥胖，多毛。妇科检查子宫未见异常，双侧卵巢稍大。基础体温单相。该患者促排卵治疗，需要注意防止的并发症是
A. 肝脏损害
B. 卵巢早衰
C. 卵泡黄素化未破裂综合征
D. 卵巢过度刺激综合征
E. 肾功能损害

正确答案：D。卵巢过度刺激综合征

解析：该患者为育龄期女性，婚后5年未孕，月经稀发，肥胖，多毛（多囊卵巢综合征多表现为月经稀发、不孕、肥胖和多毛，其中多毛为高雄激素血症最常见表现）。妇科检查：子宫未见异常，双侧卵巢稍大。基础体温单相（为无排卵的表现）。符合多囊卵巢综合征的诊断标准2项，故最可能的诊断是多囊卵巢综合征。对有生育要求者在生活方式调整、抗雄激素和改善胰岛素抵抗等基础治疗后，进行促排卵治疗。但诱发排卵时易发生卵巢过度刺激综合征（D对），需注意防治。肝脏损害（A错）、卵巢早衰（B错）、卵泡黄素化未破裂综合征（C错）、肾功能损害（E错）均不是该患者促排卵治疗中需要治疗防止的并发症。